女，50岁。右乳头皮肤脱屑、结痂半年。去除痂皮可见糜烂样创面，刮片细胞学检查：可见大而异型、胞质透明的肿瘤细胞。这种细胞称为
A. 镜影细胞
B. L&H型细胞
C. 陷窝细胞
D. Paget细胞
E. 多核瘤巨细胞

正确答案：D。Paget细胞

解析：患者中老年女性（好发人群），右乳头皮肤脱屑、结痂半年。去除痂皮可见糜烂样创面，刮片细胞学检查：可见大而异型、胞质透明的肿瘤细胞（佩吉特细胞）。结合患者细胞病理改变及临床表现初步诊断为佩吉特病，其细胞应为Paget细胞（D对）。镜影细胞（A错）是霍奇金淋巴瘤的特征性病理改变。L&H型细胞（LP细胞）（B错）、陷窝细胞（C错）和多核瘤巨细胞（E错）是R-S（镜影细胞）的变异形态。